王女士，44岁。体质指数为27.1kg/m²，她意识到自己体重超重，打算通过运动控制体重，但总是觉得没有适合自己的运动方式，迟迟没有开始行动。按照行为改变阶段理论划分，王女士处于行为改变的
A. 行动阶段
B. 无打算阶段
C. 准备阶段
D. 打算阶段
E. 行为维持阶段

正确答案：D。打算阶段

解析：行为变化阶段包括：无打算阶段、打算阶段、准备阶段、行动阶段、行为维持阶段。（1）无打算阶段（B错）：处于该阶段的人，在未来6个月中没有改变自己行为的考虑，或有意坚持不改。（2）打算阶段（D对）：处于该阶段的人打算在未来（6个月内）采取行动，改变疾病危险行为。（3）准备阶段（C错）：进入“准备阶段”的人将于未来1个月内改变行为。这些人们在过去1年中已经有所行动，并对所采取的行动已有打算，例如参加一些有关课程或购买需要的资料等。（4）行动阶段（A错）：在此阶段的人，在过去的6个月中目标行为已经有所改变。（5）行为维持阶段（E错）：处于此阶段的人已经维持新行为状态长达6个月以上，已达到预期目的。王女士意识到自己体重超重，打算控制体重，但总是觉得没有适合自己的运动方式，迟迟没有开始行动。